苯妥英钠
A. 可用于小儿感染所致呼吸衰竭
B. 不能抑制癫痫病灶异常放电，可阻止其向正常脑组织扩散
C. 临床主要用于失神性发作，为防治小发作的首选药
D. 用于苯妥英钠不能耐受的癫痫大发作
E. 苯巴比妥对大多数惊厥动物模型有效，缺乏选择性

正确答案：B。不能抑制癫痫病灶异常放电，可阻止其向正常脑组织扩散

解析：本题考查苯妥英钠。苯妥英钠属乙内酰脲类抗癫痫药物，其不能抑制癫痫病灶异常放电，可阻止其向正常脑组织扩散（B对）。临床主要用于失神性发作，为防治小发作的首选药（C错）可见于乙琥胺。用于苯妥英钠不能耐受的癫痫大发作（D错）可见于卡马西平。对大多数惊厥动物模型有效，缺乏选择性（E错）可见于苯巴比妥。